患者来药店购买双歧杆菌三联活菌制剂，药师应该交待的使用注意事项包括
A. 置于冰箱中冷藏保存
B. 与抗酸剂分开服用
C. 宜用温水送服
D. 不宜与抗菌药物同时服用
E. 可混于温牛奶中服用

正确答案：A、B、C、D、E。置于冰箱中冷藏保存；与抗酸剂分开服用；宜用温水送服；不宜与抗菌药物同时服用；可混于温牛奶中服用

解析：本题考查活菌制剂的使用。活菌制剂需冷藏储存（A对）；不宜与抗菌药物同时服用（D对）；与抗酸剂分开服用（B对）；为保持活性，用温水或混于温牛奶中服用（CE对）。